可使环孢素血浆浓度降低的药品
A. 伊曲康唑
B. 环磷酰胺
C. 氢氯噻嗪
D. 沙丁胺醇
E. 利福平

正确答案：E。利福平

解析：本题考查药物相互作用。利福平（E对）可使环孢素血浆浓度降低。降低血药浓度的药物还有抗惊厥药和其他药物（奥曲肽、噻氯匹定）。